蜘蛛痣肝掌多见于哪型肝炎
A. 急性黄疸型
B. 急性无黄疸型
C. 急性重型
D. 慢性迁延性
E. 慢性活动性

正确答案：E。慢性活动性

解析：慢性活动性肝炎的体征为肝肿大，质地中等硬度以上，并伴有蜘蛛痣、肝病面容、肝掌或脾肿大等（E对）。急性黄疸型肝炎黄疸期尿黄加深，巩膜和皮肤出现黄染，1～3周内黄疸达高峰。部分患者可有一过性粪色变浅、皮肤瘙痒、心动徐缓等梗阻性黄疸表现。肝大，质软，边缘锐利，有压痛及叩击痛。部分病例有轻度脾大。肝功能改变主要为ALT和胆红素升高，尿胆红素阳性（A错）。急性非黄疸型肝炎其起病较缓慢，症状较轻，主要表现为全身乏力、食欲下降、恶心、腹胀、肝区痛、肝大、有轻压痛及叩痛（B错）。重型肝炎（肝衰竭）的病因及诱因复杂，包括重叠感染（如乙型肝炎重叠其他肝炎病毒感染）、HBV前C区突变、机体免疫状况、妊娠、过度疲劳、精神刺激、饮酒、应用肝损药物、合并细菌感染、有其他合并症（如甲状腺功能亢进、糖尿病）等。其主要临床表现为一系列肝衰竭症候群：极度乏力，严重消化道症状，神经、精神症状（嗜睡、性格改变、烦躁不安、昏迷等），有明显出血倾向，凝血酶原时间第十版传染病学（PT）显著延长及凝血酶原活动度（PTA）<40%；黄疸进行性加深，胆红素每日上升≥17.1μmol/L或大于正常值10倍；可出现中毒性鼓肠、肝臭及肝肾综合征等；可见扑翼样震颤或病理反射；肝浊音界进行性缩小；胆酶分离；血氨升高等（C错）。慢性迁延性肝炎的病程在半年以上，虽然经过治疗但仍然迁延不愈。病人的症状、体征多较轻，病人可以经常出现轻度乏力、肝区隐痛、食欲不振、轻度腹胀等，部分病人无明显症状。常常伴有肝脏稍大，个别人脾脏也可肿大。一般情况下没有黄疸，肝功基本正常或轻度改变，谷丙转氨酶持续或间歇升高，血浆白蛋白与球蛋白数值基本正常，影像学检查肝脏的形态、结构基本正常（D错）。